男，30岁。右侧腰腹部阵发性疼痛伴恶心、呕吐1天。尿常规：RBC20～30/HP。腹部卧位X线平片未见异常。超声示右肾积水，右输尿管上段扩张，下段因肠道气体干扰无法显示。为明确诊断，应首选的检查是
A. 核素肾显像
B. MRU
C. 泌尿系CT平扫
D. 尿培养
E. 逆行肾盂造影

正确答案：C。泌尿系CT平扫

解析：患者青年男性，右侧腰腹部阵发性疼痛伴恶心、呕吐1天（输尿管结石典型临床表现）。尿常规示RBC20～30/HP（血尿），超声示右肾积水，右输尿管上段扩张（尿路不完全梗阻所致），下段因肠道气体干扰无法显示，泌尿系CT平扫（C对）能发现尿路平片等检查不能显示的或较小的输尿管中下段结石。核素肾显像（A错）不能直接显示泌尿系结石，主要用于确定分侧肾功能。MRU（B错）即磁共振水成像，不能显示尿路结石，因而一般不用于结石的检查，但能够了解结石梗阻后肾输尿管积水的清况。尿培养（D错）用于诊断尿路感染，可采用清洁中段尿、导尿及膀胱穿刺尿做细菌培养。逆行肾盂造影（E错）可以评价结石所致的肾结构和功能改变，有无引起结石的尿路异常如先天性畸形等。若有充盈缺损，则提示有X线阴性结石或合并息肉、肾盂癌等可能。本题最佳答案为泌尿系CT平扫（C对）。